治疗急性腹泻可选用
A. 双八面体蒙脱石
B. 聚乙二醇4000
C. 阿苯达唑
D. 莫沙必利
E. 多潘立酮

正确答案：A。双八面体蒙脱石

解析：本题考查阿苯达唑。治疗急性腹泻可选用双八面体蒙脱石（A对）。双八面体蒙脱石散可覆盖消化道，与黏膜蛋白结合后增强黏液屏障，防止胃酸、病毒、细菌、毒素对消化道黏膜的侵害，首剂可加倍。聚乙二醇4000（B错）、莫沙必利（D错）为缓泻药，用于便秘。阿苯达唑（C错）为广谱驱虫药。多潘立酮（E错）为促胃肠动力药，用于消化不良。